固体分散体的水溶性载体材料是
A. 聚乙烯吡咯烷酮
B. 乙基纤维素
C. β-环糊精
D. 磷脂和胆固醇
E. 聚乳酸

正确答案：A。聚乙烯吡咯烷酮

解析：本题考查骨架型缓（控）释材料。固体分散体常用的载体材料可分为水溶性、难溶性和肠溶性三大类，常用的水溶性载体材料有聚乙二醇（PEG）、聚乙烯吡咯烷酮（PVP）类（A对）、表面活性剂类、纤维素衍生物类、糖类与醇类、有机酸类等。乙基纤维素（B错）为不溶性骨架材料。β-环糊精（C错）为包合物的包合材料。磷脂和胆固醇（D错）为制备脂质体的膜材料。聚乳酸（E错）常用作缓释骨架材料、微囊囊膜材料和微球成球体材料。